肾上腺素中酮体的检查，所用的方法为
A. TLC法
B. GC法
C. HPLC法
D. IR法
E. 以上都不对

正确答案：E。以上都不对

解析：本题考查药物中杂质的检查。肾上腺素中酮体的检查，所用的方法为紫外-可见分光光度法（E对）。检查原理是利用酮体在310nm波长有最大吸收，而肾上腺素主成分在此波长几乎无吸收，因此通过限制在310nm波长处的吸光度值，即可达到限制相应酮体含量的目的。TLC法（A错）系将适宜的固定相涂布于玻璃板、塑料或铝基片上，成一均匀薄层。待点样、展开后，根据比移值（Rf）与适宜的对照物按同法所得的色谱图的比移值（Rf）作对比，用以进行药品的鉴别、杂质检查或含量测定的方法。HPLC法（C错）是以液体为流动相，采用高压输液系统、高效固定相及高灵敏度检测器进行复杂样品分离分析的色谱方法。IR法（D错）是以连续波长的中红外光为光源照射样品，引起分子振动能级跃迁，而产生红外吸收光谱，根据混合物地红外吸收光谱进行定性、定量及结构分析的方法。